五苓散的药物组成不包括
A. 泽泻
B. 茯苓
C. 猪苓
D. 苍术
E. 肉桂

正确答案：D。苍术

解析：本题考查的是五苓散的药物组成。五苓散的药物组成不包括苍术（B错，为本题正确答案）。五苓散：【药物组成】泽泻（A对）、茯苓（B对）、猪苓（C对）、白术（炒）、肉桂（E对）。